3/4冠的缺点为
A. 就位容易
B. 不能作固定桥固位体
C. 磨牙多
D. 外形线长，不利防龋
E. 以上都不是

正确答案：D。外形线长，不利防龋

解析：本题考查3/4冠的缺点。3/4冠保留牙齿唇颊面，其外形线比全冠长，加上微渗漏的可能，所以会有龋坏的可能性较大，不利于防龋（D对）。3/4冠只磨除部分牙体组织，磨除牙体组织少（C错），更符合保存牙体组织修复的原则；不用考虑基牙整体的就位道，就位容易（A错），这是优点。3/4冠可以作为间隙较小的三单位桥的固位体（B错），比如单个下前牙缺失，需要的固位力不大，3/4冠完全可以提供。